心理医生对于一名处于精神分裂症发作期患者的治疗，通过了解其日记，绘画，从而对该患者进行心理评估，该心理评估的方法为
A. 会谈法
B. 作品分析法
C. 调查法
D. 心理测验法
E. 观察法

正确答案：B。作品分析法

解析：作品分析法：对被评估者的日记、书信、图画、工艺等文化性创作和生活中做的事进行分析，可以有效地评估其心理水平和状态（B对）。会谈法：主试者与被评估者面对面的语音交流，是心理评估中最常用的一种方法（A错）。调查法：从相关的人或材料获取资料，进行调查（C错）。心理测验法包括调查问卷、投射灯方法（D错）。观察法：最基本，通过对被评估者行为表现直接或间接观察，进行心理评估（E错）。